下列属于特异性感染的是
A. 背部痈
B. 疖病
C. 急性淋巴结炎
D. 急性乳腺炎
E. 淋巴结结核

正确答案：E。淋巴结结核

解析：外科感染分为非特异性感染和特异性感染。特异性感染包括结核病（E对）、破伤风、气性坏疽、念珠菌等。疖（B错）、痈（A错）、急性乳腺炎（D错）属于非特异性感染，非特异性感染还包括丹毒、急性阑尾炎等。急性淋巴结炎（C错）一般由乙型溶血性链球菌、金黄色葡萄球菌感染引起，亦属于一般感染。